表虚自汗，易伤风邪者，宜常用的方剂是
A. 玉屏风散
B. 补肺汤
C. 防风汤
D. 参苏饮
E. 加减葳蕤汤

正确答案：A。玉屏风散

解析：表虚自汗，易伤风邪者，宜常用的方剂是玉屏风散。本方主治卫气虚弱，不能固表证，卫虚腠理不密，则易为风邪侵袭。治以益气固表止汗，本方为治疗表虚自汗的常用方（A对）。补肺汤主治养阴补肺，清热止血（B错）。防风汤主治行痹（C错）。参苏饮主治气虚外感风寒，内有痰湿证（D错）。加减葳蕤汤主治素体阴虚，外感风热证（E错）。